效度反映心理测量结果的
A. 一致性
B. 可靠性
C. 真实性
D. 代表性
E. 客观性

正确答案：C。真实性